患者女性，25岁，心悸，气促。反复咯血10年。体检:梨形心影，心尖区有舒张期隆隆样杂音，肺动脉瓣第二音亢进，心尖区第一心音亢进，有开瓣音，宜采用
A. 洋地黄
B. 利尿剂
C. 二尖瓣成形术
D. 二尖瓣置换术

正确答案：C。二尖瓣成形术

解析：本例患者诊断为风湿性心脏病，二尖瓣狭窄，伴有肺动脉高压。患者反复咯血表明由于二尖瓣峡窄致使左心房压力增高，肺静脉压增高导致支气管黏膜下的支气管静脉淤血、扩张、破裂出血。所以，用的治疗措施必须要能尽快降低肺静脉压。洋地黄、利尿剂、垂体后叶素等都不能达到此目的。二尖瓣置换术是一种根治的手段，但患者尚年轻，从体征上分析其二尖瓣瓣叶尚有弹性（因为听诊有开瓣音），所以可先考虑行二尖瓣成形术以降低左心房及肺静脉压力，解除咯血症状。目前介入性的经皮球囊二尖瓣成形术可作为首选。掌握“二尖瓣狭窄”知识点。